治疗月经过少血瘀证,应首选
A. 滋血汤
B. 归肾丸
C. 桃红四物汤
D. 乌药汤
E. 苍附导痰丸

正确答案：C。桃红四物汤

解析：瘀血内停，冲任阻滞，故经行涩少，治疗当活血化瘀调经。桃红四物汤的功效为养血活血，为月经过少血瘀证的首选（C对）。滋血汤的功效为养血调经，治疗血虚证（A错）。归肾丸的功效为补肾养肝，益精养血，治疗肾虚证（B错）。乌药汤的功效为行气活血调经，治疗气滞证之月经后期（D错）。苍附导痰丸的功效为燥湿健脾，化痰调经，治疗痰湿证（E错）。